职业病危害项目申报的主要内容不包括
A. 用人单位的基本情况
B. 职业病危害防护设施
C. 职业卫生技术服务机构的基本情况
D. 产生职业病危害因素的生产技术、工艺和材料
E. 工作场所职业病危害因素种类、浓度或强度

正确答案：C。职业卫生技术服务机构的基本情况